某女，17岁。患过敏性鼻炎10年，平日易感冒。近日因天气变化又引发旧疾，症见鼻痒、喷嚏、流清涕。治当益气固表、祛风通窍，宣选用的成药是
A. 鼻渊舒胶囊
B. 辛芩颗粒
C. 玉屏风颗粒
D. 千柏鼻炎片
E. 藿胆丸

正确答案：B。辛芩颗粒

解析：本题考查的是辛芩颗粒的功能。近日因天气变化又引发旧疾，症见鼻痒、喷嚏、流清涕。治当益气固表、祛风通窍，宣选用的成药是辛芩颗粒（B对）。辛芩颗粒：【功能】益气固表，祛风通窍。鼻渊舒胶囊（A错）：【功能】疏风清热，祛湿通窍。玉屏风颗粒（C错）：【功能】益气，固表，止汗。千柏鼻炎片（D错）：【功能】清热解毒，活血祛风，宣肺通窍。藿胆丸（E错）：【功能】芳香化浊，清热通窍。